WHO、FAO与UNEP于1976年共同设立的食品安全风险监测项目是
A. ADI
B. MOE
C. HBGV
D. JECFA
E. GEMS/Food

正确答案：E。GEMS/Food

解析：本题考查WHO、FAO与UNEP于1976年共同设立的食品安全风险监测项目。世界卫生组织（WHO）、粮农组织（FAO）与联合国环境规划署（UNEP）于1976年共同设立了全球环境监测系统/食品污染物监测项目（GEMS/Food）（E对ABCD错）。